哪种药物对抗肝素过量的自发性出血最有效
A. 维生素K
B. 维生素C
C. 垂体后叶素
D. 鱼精蛋白
E. 右旋糖酐

正确答案：D。鱼精蛋白